关于贵要静脉何种说法对
A. 起于手背静脉网桡侧
B. 汇入头静脉并延续为腋静脉
C. 注入肱静脉或腋静脉
D. 行于三角肌胸大肌间沟内
E. 无

正确答案：C。注入肱静脉或腋静脉

解析：贵要静脉起自手背静脉网的尺侧（A错）。注入肱静脉或腋静脉（C对）。行于肱二头肌内侧沟（D错）。